经行乳房胀痛涉及的脏腑是
A. 肝、脾、肾
B. 胃、脾、肾
C. 肝、胃、肾
D. 肺、肝、肾
E. 肺、肝、胃

正确答案：C。肝、胃、肾

解析：因肝经循胸胁，过乳头，乳头乃足厥阴肝经支络所属；乳房为足阳明胃经经络循行之所；足少阴肾经入乳内。故有乳头属肝、乳房属胃亦属肾之说（C对）。脾经入腹中属脾络胃，向上穿过膈肌，沿食道两旁，连舌本；分支，注入心中，不过胸胁乳房（AB错）。肺经起于中焦，下络大肠，环循胃口，通过膈肌，属肺，从肺系横行至胸部外上方而后循手臂，亦不过胸胁乳房部（DE错）。